慢性胃体炎的主要表现为
A. 血清抗壁细胞抗体阳性
B. 血清内因子抗体阴性
C. 胃液酸度正常
D. 血清促胃液素含量低下
E. 约10%发生癌变

正确答案：A。血清抗壁细胞抗体阳性